旋转力除可用于上前牙拔除外，还可用于
A. 上颌双尖牙
B. 上颌智齿
C. 下前牙
D. 下颌双尖牙
E. 下颌智齿

正确答案：D。下颌双尖牙

解析：本题考查各类牙拔除术。旋转力除可用于上前牙拔除外，还可用于下颌双尖牙（D对）。下颌双尖牙均为锥形单根，拔牙动作主要为颊舌向摇动，辅以小幅度的扭转，更容易使牙齿脱位。上颌双尖牙为扁根，上颌第一前磨牙多为颊腭二根，上颌第二前磨牙多为单根，拔除时以颊舌向摇动为主，使用扭转力会发生断根（A错）。下颌切牙牙根扁平、细短，不可用扭转力（C错）。上颌智齿（B错）和下颌智齿（E错）牙根变异大，且多埋伏阻生，因此不宜用扭转力。